结构中含1位乙基的抗菌药是
A. 盐酸诺氟沙星
B. 磺胺嘧啶
C. 氧氟沙星
D. 司帕沙星
E. 甲氧苄啶

正确答案：A。盐酸诺氟沙星

解析：本题考查喹诺酮类抗菌药。盐酸诺氟沙星（A对）是结构中含1位乙基的喹诺酮类药物。将喹诺酮类1位和8位成环得到氧氟沙星（C错）。司帕沙星1位为环丙基（D错）。磺胺嘧啶（B错）、甲氧苄啶（E错）不含有乙基取代基。